男，35岁。间断血压增高伴心悸3个月。查体：正力体型，双上肢血压180/110mnHg，双肺呼吸音清，心率78次/分，律齐，腹软，腹部未闻及杂音。血压增高时测血游离间苄肾上腺素、去甲肾上腺素和尿儿茶酚胺显著增髙。血钾和肌酐正常，尿常规正常。CT示双肾、肾上腺和肾动脉未见异常。该患者需首先考虑的疾病是
A. 肾动脉狭窄
B. 嗜铬细胞瘤
C. 皮质醇增多症
D. 原发性醛固酮增多症
E. 肾上腺皮质功能减退症

正确答案：B。嗜铬细胞瘤

解析：高血压为嗜铬细胞瘤最主要的症状，阵发性高血压为其特征性表现，阵发性者平时儿茶酚胺可不明显升高，而在发作后才高于正常。患者间断性高血压伴心悸3个月，双上肢血压升高，血压增高时测血游离间苄肾上腺素、去甲肾上腺素和尿儿茶酚胺显著增髙。 根据患者的临床症状，实验室检查，患者需首先考虑的疾病是嗜铬细胞瘤（B对）。CT示双肾、肾上腺和肾动脉未见异常，可排除肾动脉狭窄（A错）。皮质醇增多症（C错）（P699）为各种病因造成肾上腺分泌过多糖皮质激素（主要是皮质醇）所致病症的总称，典型病例表现为向心性肥胖、满月脸、多血质、紫纹等。原发性醛固酮增多症（D错）（P703）是由肾上腺皮质病变致醛固酮分泌增多并导致水、钠潴留及体液容量扩增继而血压增高并抑制肾素-血管紧张素所致。肾上腺皮质功能减退症（E错）（P707）又称Addison病，由于双侧肾上腺绝大部分被毁所致。最具特征性者为全身皮肤色素加深，暴露处、摩擦处、乳晕、瘢痕等处尤为明显，粘膜色素沉着见于齿龈、舌部、颊粘膜等处。